碘解磷定治疗有机磷酸酯农药中毒的主要机制是
A. 与磷酰化胆碱酯酶结合，使酶复活
B. 与胆碱酯酶结合，使酶功能增强
C. 与胆碱受体结合，使受体不能激动
D. 与“老化”的胆碱酯酶结合，使酶复活
E. 与乙酰胆碱结合，阻止其作用于受体

正确答案：A。与磷酰化胆碱酯酶结合，使酶复活

解析：本题考查药物的作用机制。碘解磷定治疗有机磷酸酯农药中毒的主要机制是与磷酰化胆碱酯酶结合，使酶复活（A对）。碘解磷定进入中毒机体后，其带正电的季铵阳离子能与磷酰化胆碱酯酶的阴离子部位以静电引力结合，形成磷酰化胆碱酯酶复合物，后再经裂解，使胆碱酯酶游离出来而恢复其水解乙酰胆碱的活性。但对已经老化的酶，解毒效果很差（D错）。